可引起外周水肿的药品是
A. 氢氯噻嗪
B. 曲克芦丁
C. 氨氯地平
D. 依那普利
E. 普萘洛尔

正确答案：C。氨氯地平

解析：本题考查药物的不良反应。可引起外周水肿的药品是氨氯地平（C对）。外周水肿可见于各类钙拮抗剂，以二氢吡啶类发生率最高。常用的二氢吡啶类药物有氨氯地平、硝苯地平、非洛地平等。氢氯噻嗪（A错）的不良反应：低血钾、低血钠、低血镁、低氯性碱血症、高尿酸血症、高血糖、过敏反应等。曲克芦丁（B错）属于毛细血管保护类药物，偶见胃肠道反应（如恶心、便秘等）、过敏反应（如面部潮红、头痛等）。依那普利（D错）为ACEI类药物，主要的不良反应有高血钾、肾功能损害、咳嗽、血管神经性水肿等。普萘洛尔（E错）属于β受体阻断剂，主要不良反应有支气管痉挛、撤药综合征等。